某男，26岁。咳嗽3日，症见干咳、连声作呛、喉痒干痛、唇鼻干燥、痰少而黏、不易咯出、心烦口渴，舌红干而少津、苔薄白、脉浮数。证属风燥伤肺、肺失清润。治以疏风清肺、润燥止咳。处方：桑叶9g、薄荷3g、苦杏仁9g、南沙参9g、天花粉10g、浙贝母9g、芦根10g、前胡10g、炒牛蒡子10g、淡豆豉10g、桔梗5g，7剂，每日1剂，水煎服。方中入汤剂宜后下的中药是
A. 桑叶
B. 炒牛蒡子
C. 芦根
D. 薄荷
E. 天花粉

正确答案：D。薄荷

解析：本题考查薄荷的用法用量。方中入汤剂宜后下的中药是薄荷（D对）。薄荷【用法用量】内服：煎汤，2～10g；或入丸散；不宜久煎，入汤剂当后下。桑叶（A错）【用法用量】内服：煎汤，5～10g；或入丸散。外用：适量，煎水洗眼或捣敷。润肺止咳宜蜜炙用。炒牛蒡子（B错）【用法用量】内服：煎汤，3～10g；或入丸散。入煎剂宜打碎，炒用寒性略减。芦根（C错）【用法用量】内服：煎汤，10～30g，鲜品可酌加。鲜用或捣汁饮，清热生津力佳。天花粉（E错）【用法用量】内服：煎汤，10～15g；或入丸散。外用：适量，研末，水或醋调敷。疮肿未脓可消，已脓可溃，脓多促排，脓尽不用。使用注射液需作皮试。